病例对照研究中最常见的偏倚有
A. 回忆偏倚
B. 选择偏倚
C. 调查员偏倚
D. 混杂偏倚
E. 测量偏倚

正确答案：B。选择偏倚